下列各项中，需用砭镰法治疗的是
A. 托盘疔
B. 颜面部疔
C. 红丝疔
D. 蛇眼疔
E. 蛀节疔

正确答案：C。红丝疔

解析：红丝疔，是发生于四肢，皮肤呈红丝显露，迅速向上走窜的急性感染性疾病，相当于西医的急性淋巴管炎，若红丝细的宜用砭镰法，局部皮肤消毒后，以刀沿红丝行走途径，寸寸挑断，并用拇指和食指轻捏针孔周围皮肤，微令出血，或在红丝尽头挑断，挑破处均盖贴太乙膏掺红灵丹（C对）。托盘疔，生于手掌心劳宫穴处，肿形如托盘之状，在溃脓期可依掌横纹切开排脓（A错）。颜面部疔，是指发生于颜面部的急性化脓性疾病，初期有粟粒样脓头，中期肿势逐渐增大，四周浸润明显，疼痛加剧，脓头破溃，后期肿势局限，顶高根软溃脓，脓栓随脓外出，肿消痛止，无需使用砭镰法，初起宜箍毒消肿，用金黄散、玉露散以金银花露或水调成糊状围敷，脓成宜提脓去腐，用九一丹、八二丹撒于疮顶部，再用玉露散或千锤膏敷贴，脓溃后宜提脓去腐，生肌收口，疮口用九一丹，外用金黄膏，脓尽改用生肌散、太乙膏或红油膏盖贴（B错）。蛇眼疔，生于指甲缘，因其色紫而凸，或溃后胬肉高突，形如蛇眼，在溃脓期宜沿甲旁0.2cm挑开引流（D错）。蛀节疔，是生在手指指节间，绕指肿痛，色黄或紫，溃脓期循经切开引流（E错）。